阿片类药物与解热镇痛抗炎药配伍后，主要发挥
A. 中枢镇痛作用
B. 外周镇痛作用
C. 中枢和外周双重镇痛作用
D. 中枢和外周双重解热作用
E. 中枢解热作用

正确答案：C。中枢和外周双重镇痛作用

解析：本题考查阿片类药物和解热镇痛抗炎药的配伍效果。阿片类药物与解热镇痛抗炎药配伍后，主要发挥中枢和外周双重镇痛作用（C对）。阿片类药物作用于中枢，起到中枢镇痛的作用（B错），解热镇痛抗炎药作用于外周，起到外周镇痛的作用（A错），合并使用可以起到中枢和外周双重镇痛作用（DE错）。